对放射治疗高度敏感的肿瘤是
A. 恶性淋巴瘤
B. 鳞状细胞癌
C. 基底细胞癌
D. 骨肉瘤
E. 鼻咽癌

正确答案：A。恶性淋巴瘤

解析：对放射线敏感的肿瘤：恶性淋巴瘤、浆细胞肉瘤、未分化癌、淋巴上皮癌、尤文（Ewing）肉瘤等。掌握“恶性淋巴瘤”知识点。